下列有关Hb的叙述哪一项是不正确的
A. Hb是一条多肽链和一个血红素结合而成，其氧解离曲线是直角曲线
B. Hb是α2β2四聚体，所以一分子Hb可结合四分子氧
C. Hb各亚基携带O2时，具有正协同效应
D. O2是结合在血红素的Fe2+上
E. 大部分亲水基团位于Hb分子的表面

正确答案：A。Hb是一条多肽链和一个血红素结合而成，其氧解离曲线是直角曲线

解析：别构酶与它们的底物结合、Hb与O2结合均呈特征性“S”型曲线。掌握“蛋白质结构与功能关系”知识点。